女，35岁。人工流产后6年未孕，月经规律，月经来潮12小时子宫内膜活检为分泌期子宫内膜，子宫输卵管造影（HSG）示双侧输卵管近端梗阻。丈夫精液正常。为生育，最适宜的下一步治疗是
A. 促排卵治疗
B. 配子输卵管内移植
C. 卵细胞质内单精子注射
D. 体外受精一胚胎移植
E. 宫腔内人工受精

正确答案：D。体外受精一胚胎移植

解析：中年女性患者，人工流产后6年未孕，月经规律，造影示双侧输卵管堵塞，其他检查无异常，丈夫精液正常，根据病史和检查，考虑诊断为输卵管性不孕症（临床上对输卵管性不孕症患者，在通过其他常规治疗无法妊娠，为IVF-ET的适应症）。适宜的辅助生育是体外受精-胚胎移植（D对），其是指从妇女卵巢内取出卵子，在体外与精子发生受精并培养3～5日，再将发育到卵裂期或囊胚期阶段的胚胎移植到宫腔内，使其着床发育成胎儿的全过程，俗称“试管婴儿”。促排卵治疗（A错），是指使用排卵药物，促使卵巢排卵；配子输卵管内移植（B错）是将配子，即成熟的卵子及获能的精子，通过腹腔镜或腹部小切口直接放进输卵管壶腹部，使精子和卵子在体内正常输卵管内自然受精，然后受精卵通过输卵管管壁的纤毛运动移行到子宫内着床发育；宫腔内人工授精（P372）（E错）是将精子通过非性交方式注入女性生殖道内使其受孕的一种技术，适用于具备正常发育的卵泡、正常范围的活动精子数目，健全的女性生殖道结构，至少一条通畅的输卵管的不孕（育）症夫妇。以上三种辅助生殖技术均需至少一条通畅的输卵管，不适用于本例患者。卵细胞质内单精子注射（C错）（P373）主要用于治疗重度少、弱、畸形精子症的男性不育患者。